下列关于白血病龈病损的病理变化叙述有误的
A. 牙龈上皮和结缔组织内充满密集的幼稚血细胞
B. 可见正常的中性粒细胞
C. 可见淋巴细胞和浆细胞的灶性浸润
D. 胶原纤维被幼稚血细胞所代替
E. 毛细血管收缩，可见组织坏死

正确答案：E。毛细血管收缩，可见组织坏死

解析：本题考查白血病的牙龈病损。下列关于白血病龈病损的病理变化叙述有误的是毛细血管收缩，可见组织坏死（E错，为本题的正确答案）。白血病是一种恶性血液疾病，大量增殖的不成熟血细胞充斥骨髓腔并取代了正常的骨髓组织，血液中不成熟血细胞的数量和形态异常，并可浸润至身体各器官和组织，包括牙龈。发生牙龈肿大者，最常见的是急性单核细胞白血病和急性粒细胞白血病，也可见于急性淋巴细胞白血病，有学者报告约有3.6%的白血病患者出现牙龈肿胀。患者常因牙龈肿胀和出血而首先就诊于口腔科。白血病龈病损的病因：白血病患者末梢血中的幼稚血细胞，在牙龈组织内大量浸润积聚，致使牙龈肿大，这是白血病的牙龈病损的原因，而并非牙龈结缔组织本身的增生。由于牙龈肿胀、出血，口内自洁作用差，使菌斑大量堆积，加重了牙龈的炎症。白血病龈病损的病理变化：病理变化为牙龈上皮和结缔组织内充满密集的幼稚血细胞（A对），偶见正常的中性粒细胞（B对）、淋巴细胞和浆细胞的灶性浸润（C对）。结缔组织高度水肿变性，胶原纤维被幼稚血细胞所代替（D对）。毛细血管扩张，血管腔内可见血细胞形成栓塞，并可见组织坏死。